妊娠早期保健要点
A. 系统产前检查
B. 预防胎儿发育异常
C. 产前诊断
D. 胎教
E. 孕妇体操

正确答案：B。预防胎儿发育异常

解析：本题考查妊娠早期保健的主要目的。妊娠早期保健的主要目的是确定宫内妊娠及孕周，全面评价孕妇与胎儿健康状况，防止胎儿发育异常（B对ACDE错）筛查不宜妊娠者，提供孕产期保健指导。